标识为红色椭圆形背景下的OTC是
A. 一类精神药品
B. 处方药
C. 非处方药
D. 甲类非处方药
E. 乙类非处方药

正确答案：D。甲类非处方药

解析：本题考查处方药。标识为红色椭圆形背景下的OTC是甲类非处方药（D对）。非处方药（C错）专有标识图案分为红色和绿色，红色专有标识用于甲类非处方药品，绿色专有标识用于乙类非处方药品（E错）和用作指南性标志。精神药品（A错）专有标识为白色和绿色。处方药（B错）无OTC标识。